下列哪个选项非涎腺造影的适应证
A. 涎腺慢性炎症
B. 舍格伦综合征
C. 涎瘘
D. 涎腺急性炎症
E. 涎腺导管阴性结石

正确答案：D。涎腺急性炎症

解析：唾液腺造影术适应证：①唾液腺慢性炎症；②舍格伦综合征；③唾液腺良性肥大；④唾液腺肿瘤；⑤涎瘘；⑥导管阴性结石；⑦确定唾液腺周围组织病变是否累及腺体与导管等。唾液腺造影术禁忌证：①对碘化合物过敏；②唾液腺急性炎症期间；③唾液腺导管阳性结石，以避免注射造影剂时将结石向后推移。掌握“唾液腺造影技术、CT及MRI”知识点。